患者，女，32岁，已婚。经行肢体肿胀，按之随手而起，经色黯红有块，伴脘闷胁胀，善叹息，舌紫黯，苔薄白，脉弦涩。治疗应首选
A. 苓桂术甘汤
B. 参苓白术散
C. 八物汤
D. 肾气丸
E. 丹栀逍遥丸

正确答案：C。八物汤

解析：该患者经行肢体肿胀，按之随手而起，经色黯红有块，故诊断为经行浮肿。冲任气血壅盛，气滞益甚，水湿运化不利，泛溢肌肤，故经行肢体肿胀；气滞血瘀则经血运行不畅，故经色黯红有块；肝郁气滞，脘闷胁胀，善叹息；舌紫黯，苔薄白，脉弦涩均为气滞血瘀之征，故辨为气滞血瘀证，治宜理气行滞，养血调经。苓桂术甘汤合肾气丸功能温肾化气，健脾利水，为治疗经行肿胀脾肾阳虚证的选方（A错）。参苓白术散功能益气健脾，渗湿止泻，主治脾虚湿盛证（B错）。经行肿胀气滞血瘀证治宜理气行滞，养血调经，方选八物汤（C对）。肾气丸合苓桂术甘汤功能温肾化气，健脾利水，为治疗经行肿胀脾肾阳虚证的选方（D错）。丹栀逍遥丸功能养血健脾，疏肝清热，主治肝郁血虚，内有郁热证（E错）。